某尸检发现，其肺体积增大边缘钝圆。色灰白，质软而缺乏弹性，指压后遗留压痕。则此人死因可能是
A. 肺癌
B. 肺结核
C. 矽肺
D. 肺气肿
E. 以上都不可能

正确答案：D。肺气肿